下列各项，不属乙脑中枢性呼吸衰竭原因的是
A. 缺氧
B. 脑水肿
C. 脑实质炎症
D. 低血钠性脑病
E. 脊髓病变致膈肌麻痹

正确答案：E。脊髓病变致膈肌麻痹

解析：乙脑中枢性呼吸衰竭多见于重症患者，由脑实质炎症（C对）、缺氧（A对）、脑水肿（B对）、颅内高压、脑疝和低钠性脑病（D对）等所致（E错，为本题正确答案）。